位于冠状沟后部的结构是
A. 三尖瓣
B. 二尖瓣
C. 冠状窦
D. 窦房结
E. 房室结

正确答案：C。冠状窦

解析：冠状窦（C对）位于心隔面，左心房与左心室之间的冠状沟后部。